下列有关隔离的叙述，错误的是
A. 是控制传染病学流行的重要措施
B. 便于管理传染源
C. 可防止病原体向外扩散给他人
D. 根据传染病学的平均传染期来确定隔离期限
E. 某些传染病学患者解除隔离后尚应进行追踪观察

正确答案：D。根据传染病学的平均传染期来确定隔离期限

解析：隔离是指把传染期内的患者或病原携带者置于不能传染给他人的条件之下，防止病原体向外扩散（C对），便于管理（B对）、消毒和治疗。这是控制传染病流行的一项重要内容和措施（A对）。应针对不同传染病的病原学和流行病学特点，采取相应的隔离措施和隔离检疫期限。对于不明原因的突发传染病，有效的隔离措施在控制其进一步扩散方面起着决定性的作用。某些传染病患者出院后尚应追踪观察（E对）（D错，为本题正确答案）。